夏季，某青年工人在炼钢炉前工作，饮水较少，至下午3时突然感到头晕、双下肢疼痛难忍，时而缓解，时而发作。经检查，患者体温37℃、神志清楚。对该病人的诊断可能是
A. 热晕厥
B. 日射病
C. 热射病
D. 热衰竭
E. 热痉挛

正确答案：E。热痉挛

解析：本题考查热痉挛的症状。热痉挛（E对ABCD错）是由于大量出汗，体内钠、钾过量丢失所致。由于水和电解质平衡紊乱导致明显的肌肉痉挛，伴有收缩痛。痉挛以四肢肌肉及腹肌等经常活动的肌肉为多见，尤以腓肠肌为最。痉挛常呈对称性，时而发作，时而缓解。病人神志清醒，体温多正常。题中工人的症状符合热痉挛的症状，诊断为热痉挛。